最容易引起细菌污染反应的血液制品是
A. 浓缩红细胞
B. 白蛋白
C. 新鲜冰冻血浆
D. 冷沉淀
E. 浓缩血小板

正确答案：E。浓缩血小板

解析：因为血小板的保存温度为22℃左右，温度较为适宜细菌生存繁殖，因此血小板（E对）是最容易引起细菌污染反应的血液制品。浓缩红细胞（A错）及冷沉淀（P26）（D错）的保存温度为4℃左右，白蛋白（B错）一般在2～8℃的暗处保存，新鲜冰冻血浆（C错）的保存温度一般为零下30℃~零下20℃，温度均不适合细菌生长繁殖。